患儿，11岁，咳喘哮鸣，痰稠色黄，胸膈满闷，声高息涌，呼气延长，便秘溲黄，舌红苔黄腻，脉滑数。治疗应首选
A. 五虎汤合葶苈大枣泻肺汤
B. 麻杏石甘汤合苏葶丸
C. 小青龙汤合三子养亲汤
D. 清宁散合三子养亲汤
E. 射干麻黄汤

正确答案：B。麻杏石甘汤合苏葶丸

解析：患儿咳喘哮鸣，声高息涌，呼气延长，当属哮喘，其热邪灼津成痰，故见痰稠色黄，热伤津液，故见便秘溲黄，舌脉亦为热象，治宜清肺涤痰，止咳平喘，方用麻杏石甘汤合苏葶丸（B对）。五虎汤合葶苈大枣泻肺汤功能清热涤痰，开肺定喘，用于肺炎喘嗽之痰热闭肺证（A错）。小青龙汤合三子养亲汤功可温肺散寒，化痰定喘，用于寒性哮喘（C错）。清宁散合三子养亲汤功能清肺化痰，用于痰热咳嗽偏痰湿重者（D错）。射干麻黄汤功能宣肺祛痰，下气止咳，可用于哮喘肺实肾虚之偏肺实者（E错）。